颧弓骨折
A. 前段多见、骨折线处呈Y形
B. 前段多见、骨折线处呈M形
C. 中段多见、骨折线处呈Y形
D. 中段多见、骨折线处呈M形
E. 后段多见、骨折线处呈Y形

正确答案：D。中段多见、骨折线处呈M形

解析：本题考查颌面部骨骨折。颧弓骨折中段多见、骨折线处呈M形（D对）。颧骨骨折常在骨缝处裂开，可呈嵌入性或粉碎性骨折，多伴有上颌窦外侧壁骨折。颧弓骨折以颧弓中段多见，如为三线骨折，则在骨折线处呈M形。